男，45岁。心肌梗死术后，需要继续使用阿司匹林的时间为
A. 6个月
B. 12个月
C. 18个月
D. 3个月
E. 8周

正确答案：B。12个月

解析：出院后要坚持长期药物治疗，控制缺血症状，降低心肌梗死和死亡的发生，包括服用双联抗血小板药物至少12个月（B对）。